小唾液腺约占
A. 70%～85%
B. 60%～65%
C. 22%～30%
D. 2%～4%
E. 7%～8%

正确答案：E。7%～8%

解析：本题考查唾液的分泌和调节。小唾液腺约占7%～8%（E对）。正常成人每天的唾液分泌量为1000～1500mL，其中的绝大多数来自三对大唾液腺。在无任何刺激的情况下，唾液的基础分泌为每分钟0.5mL。下颌下腺静止时分泌量最大，占60%～65%；腮腺占22%～30%，但对于进食等刺激的反应大于下颌下腺；舌下腺约占2%～4%；小唾液腺约占7%～8%。